可以做强心药的是
A. HMG-CoA还原酶抑制剂
B. 磷酸二脂酶抑制剂
C. 碳酸酐酶抑制剂
D. 血管紧张素转换酶抑制剂
E. 环氧合酶抑制剂

正确答案：B。磷酸二脂酶抑制剂

解析：本题考查强心药。磷酸二脂酶抑制剂（B对）可以做强心药，通过抑制磷酸二酯酶Ⅲ的活性，升高细胞内cAMP水平，从而产生心收缩力加强和扩张血管作用。HMG-CoA还原酶抑制剂（A错）是调节血脂药。碳酸酐酶抑制剂（C错）目前多用于治疗青光眼。血管紧张素转换酶抑制剂（D错）主要用于降压。环氧合酶抑制剂（E错）为解热镇痛抗炎药。